占口腔及唇癌的第六位的是
A. 上颌窦癌
B. 口底癌
C. 牙龈癌
D. 腭癌
E. 颊癌

正确答案：B。口底癌

解析：口底癌与西方国家比较，我国的口底癌较为少见。居口腔及唇癌的第六位。掌握“颊癌、口底癌及唇癌”知识点。